下列关于流行性出血热发热期三痛的叙述，正确的是
A. 全身酸痛、头痛、眼眶痛
B. 头痛、腓肠肌痛、腰痛
C. 腹痛、腰痛、眼眶痛
D. 头痛、腰痛、眼眶痛
E. 全身酸痛、腰痛、眼眶痛

正确答案：D。头痛、腰痛、眼眶痛

解析：关于流行性出血热发热期三痛的叙述，正确的是头痛、腰痛、眼眶痛（D对），头痛为脑血管扩张所致，腰痛与肾周围组织充血、水肿以及腹膜后水肿有关，眼眶痛是眼球周围组织水肿所致。